某男，28岁。患咳嗽吐痰半月，每日起床即咳嗽、吐微黄黏痰，尿黄，舌红苔薄黄。近5日来，痰中带血丝，每日鼻衄1次。治当清肺化痰、止血，宜选用的
A. 儿茶
B. 硼砂
C. 轻粉
D. 五倍子
E. 炉甘石

正确答案：A。儿茶

解析：本题考查的是儿茶的功效。患咳嗽吐痰半月，每日起床即咳嗽、吐微黄黏痰，尿黄，舌红苔薄黄。近5日来，痰中带血丝，每日鼻衄1次。治当清肺化痰、止血，宜选用的儿茶（A对）。儿茶：【功效】收湿敛疮，生肌止血，活血止痛，清肺化痰。硼砂（B错）：【功效】外用清热解毒，内服清肺化痰。轻粉（C错）：【功效】外用杀虫、攻毒、敛疮；内服祛痰消积，逐水通便。五倍子（D错）：【功效】敛肺降火，涩肠固精，敛汗止血，收湿敛疮。炉甘石（E错）：【功效】明目去翳，收湿生肌。